属于M胆碱受体激动剂的降低眼压药是
A. 毛果芸香碱
B. 甘露醇
C. 乙酰唑胺
D. 噻吗洛尔
E. 地匹福林

正确答案：A。毛果芸香碱

解析：本题考查降低眼压药的分类。毛果芸香碱（A对）为M胆碱受体激动剂。甘露醇（B错）又称木蜜醇，是山梨糖醇的同分异构体。乙酰唑胺（C错）为碳酸酐酶抑制剂。噻吗洛尔（D错）为β受体阻断剂。地匹福林（E错）为肾上腺素受体激动剂。